药学原始文献主要登载于
A. 《医学索引》
B. 《中国药学文摘》
C. 期刊杂志
D. 《医学文摘》
E. 万方数据资源系统

正确答案：C。期刊杂志

解析：本题考查药物信息的分类。药学原始文献主要登载于期刊杂志（C对）。原始文献资料为一级信息源，期刊杂志是主要的一级信息源。《医学索引》（A错）、《中国药学文摘》（B错）、《医学文摘》（D错）以及万方数据资源系统（E错）都属于二级信息源。